制定《中华人民共和国药品管理法》的宗旨是
A. 加强药品管理，制止药品经营不正当竞争，稳定市场价格水平，保障消费者的合法权益
B. 打击走私、制造毒品，维护社会管理秩序
C. 鼓励研究、创制新药，发展我国医药事业
D. 加强药品监督管理，保证药品质量，保障人体用药安全，维护人民身体健康和用药的合法权益
E. 加强药品监督检验，打击制售假劣药品的违法活动，保证人民用药安全，维护人民身体健康

正确答案：D。加强药品监督管理，保证药品质量，保障人体用药安全，维护人民身体健康和用药的合法权益

解析：本题考查的是品管理立法的目的。制定《中华人民共和国药品管理法》的宗旨是加强药品监督管理，保证药品质量，保障人体用药安全，维护人民身体健康和用药的合法权益（D对）。药品管理立法是指由特定的国家机关，依据法定的权限和程序，制定、认可、修订、补充和废除药品管理法律规范的活动。药品管理立法的目的是加强药品监督管理，保证药品质量，保障人体用药安全，维护人民身体健康和用药的合法权益。药品监督管理是指药品监督管理行政机关依照法律法规的授权，依据相关法律法规的规定，对药品的研制、生产、流通和使用环节进行管理的过程。健康中国建设，需要不断完善药品安全法律法规，健全药品安全监管体制，加强药品安全监管能力建设，推动药品安全社会共治，为保障公众用药安全和合法权益，保护和促进公众健康提供保障。